上颌动脉营养的部位的描述中，哪项错误
A. 咬肌和颞肌
B. 硬脑膜和脑
C. 上颌牙齿和牙龈等
D. 下颌牙齿和牙龈等
E. 翼内肌和翼外肌

正确答案：B。硬脑膜和脑

解析：咬肌和颞肌（A对）、上颌牙齿和牙龈等（C对）、下颌牙齿和牙龈等（D对）、翼内肌和翼外肌（E对）、硬脑膜均为上颌动脉营养的部位。脑（B错，为本题正确答案）不是上颌动脉营养的部位。